每次哺乳时，母乳中呈先低后高变化的营养成分是
A. 矿物质
B. 维生素
C. 脂肪
D. 蛋白质
E. 碳水化合物

正确答案：C。脂肪

解析：母乳中呈先低后高变化的营养成分脂肪，随着小儿成长，小儿需要大量的能量，以提供成长的需要（C对）。蛋白质的变化成先高后低（D错）。矿物质（A错）、维生素（B错）、碳水化合物（E错）的营养成分都较恒定。